关于椎体间的连结，正确的是
A. 椎体间的连结包括椎间盘和前、后纵韧带
B. 椎间盘是椎体间的关节
C. 前纵韧带下达尾骨
D. 后纵韧带较前纵韧带宽
E. 前纵韧带防止椎间盘向后脱出

正确答案：A。椎体间的连结包括椎间盘和前、后纵韧带

解析：椎体之间借椎间盘及前、后纵韧带相连（A对）。椎骨的椎体之间的椎间盘是纤维软骨联合（B错）。前纵韧带上自枕骨大孔前缘，下达第 1或第 2 骶椎椎体（C错），有防止脊柱过度后伸和椎间盘向前脱出的作用（E错）。后纵韧带位于椎管内椎体的后面，窄而坚韧（D错）。